支气管-肺感染和阻塞是主要发病因素的疾病是
A. 支气管扩张症
B. 支气管肺癌
C. 慢性支气管炎
D. 支气管哮喘
E. 阻塞性肺气肿

正确答案：A。支气管扩张症

解析：支气管扩张症（A对）多见于儿童和青年，其中大多数继发于支气管-肺感染和阻塞，使支气管反复发生炎症，致使支气管壁结构破坏，所引起的支气管异常和持久性扩张。支气管肺癌（P75-P76）（B错）的病因和发病机制尚未明确，通常认为与吸烟、职业致癌因子、空气污染和电离辐射等因素有关。慢性支气管炎（P19）（C错）的病因尚不完全清楚，可能是吸烟、职业粉尘和化学物质等环境因素与机体自身因素长期相互作用的结果。支气管哮喘（P28）（D错）是一种复杂的、具有多基因遗传倾向的疾病，发病具有家族聚集现象。阻塞性肺气肿（E错）与炎症机制、蛋白酶-抗蛋白酶失衡机制、氧化应激机制等有关。